繁殖期杀菌药是
A. 头孢菌素
B. 氯霉素
C. 磺胺嘧啶
D. 异烟肼
E. 庆大霉素

正确答案：A。头孢菌素

解析：本题考查繁殖期杀菌药。头孢菌素（A对）对处于繁殖期正大量合成细胞壁的细菌作用强，而对已合成细胞壁、处于静止期者作用弱，故属于繁殖期杀菌剂。氯霉素（B错）通过抑制细菌蛋白质的合成发挥抗菌作用。磺胺嘧啶（C错）通过干扰叶酸代谢发挥抗菌作用。异烟肼（D错）为抗结核分枝杆菌药物，是窄谱抗菌药。庆大霉素（E错）可抑制细菌蛋白质合成的全过程，同时还可影响细菌细胞膜屏障功能，导致细胞死亡，为静止期杀菌药。